中国药典中，测定磺胺甲噁唑原料药含量的方法是
A. 用亚硝酸钠滴定液滴定的容量分析法
B. 用氢氧化钠滴定液滴定的容量分析法
C. 用高氯酸滴定液滴定的容量分析法
D. 气相色谱法
E. 高效液相色谱法

正确答案：A。用亚硝酸钠滴定液滴定的容量分析法